猩红热的诊断最可靠的依据是
A. 血清学试验
B. 细菌的分离培养
C. 病史和临床症状
D. 流行病学资料和临床表现
E. 临床表现

正确答案：B。细菌的分离培养